女，16岁。被倒塌的房屋压伤后腹痛伴呕吐1小时。查体：P140次/分，R26次/分，BP80/54mmHg。神志清，痛苦面容，腹肌紧张，有压痛和反跳痛，移动性浊音（+），肠鸣音消失。伤后1小时，对判断有无腹部脏器损伤价值最小的实验室检查结果是
A. 粪便常规有大量红细胞
B. 血细胞比容下降
C. 尿中可见大量红细胞
D. 红细胞及血红蛋白下降
E. 白细胞及中性粒细胞升高

正确答案：E。白细胞及中性粒细胞升高

解析：青少年女性患者，外伤后腹痛伴呕吐，P140次/分（正常为60～100次/分），BP80/50mmHg（正常为90～139/60～89mmHg，脉快、血压下降提示腹腔内出血），腹肌紧张，有压痛和反跳痛（腹膜刺激征），移动性浊音阳性（提示腹腔实质性脏器破裂出血），结合患者病史和临床表现，应考虑为闭合性腹部损伤伴腹腔脏器损伤。伤后1小时血白细胞及中性粒细胞升高（E对）为机体对创伤的一种应激反应，诊断价值不大。粪便常规有大量红细胞（A错）提示肠道损伤出血，血细胞比容（B错）、红细胞及血红蛋白下降（D错）提示腹腔内出血，尿中可见大量红细胞（C错）提示肾脏损伤，上述实验室检查结果均对腹部损伤具有一定的诊断价值。